关于密质骨的说法错误的是
A. 密质骨在X线片上又称为硬骨板
B. 由于密质骨多孔，又称筛状板
C. 固有牙槽骨组织学上属于密质骨
D. 密质骨在近牙周膜侧称为束状骨
E. 密质骨在近牙周膜侧有哈弗系统组成

正确答案：E。密质骨在近牙周膜侧有哈弗系统组成

解析：本题考查牙槽骨的组织结构。密质骨在近牙周膜侧有哈弗系统组成（E错，为本题正确答案），不属于牙槽骨的组织结构特点，应该是在邻近骨髓侧。由于有大量的外源性胶原纤维的埋入，所以固有牙槽骨又称为束骨（ bundle bone）（D对），束骨中所包埋的胶原纤维较骨硬板中略少，呈现一种低纤维结构。在邻近骨髓侧，由骨板和哈弗系统所构成，其外层有几层骨板呈同心圆排列，内有神经和血管通过。固有牙槽骨衬于牙槽窝内壁包绕牙根与牙周膜相邻，在牙槽嵴处与外骨板相连。它是一层多孔的骨板，又称筛状板（B对）。牙周膜的血管和神经纤维穿过小孔进人骨髓腔中，由于固有牙槽骨很薄，无骨小梁结构，在X线片表现为围绕牙周膜外侧的一条白色阻射线，称骨硬板（A对）。组织学上固有牙槽骨由平行排列的骨板构成，与牙槽窝壁平行，构成骨板的内源性胶原纤维较粗大，故固有牙槽骨在组织学上属于密质骨（C对）。